患者半年来频繁照镜子，感到自己的鼻子、眼睛比以前大了一倍。该患者的症状为
A. 错觉
B. 幻触
C. 视物变形
D. 非真实感
E. 幻视

正确答案：C。视物变形

解析：错觉（A错）：指对客观事物歪曲的知觉，常表现为看错物体。幻触（B错）：指在没有任何刺激时，患者感到皮肤上有某种异常的感觉。视物变形症（C对）：指患者看到周围的人或物体的形状、大小、体积等方面发生了变化。非真实感（D错）：指患者感到周围事物和环境变得不真实，犹如隔了一层窗纱。幻视（E错）：指患者看到了并不存在的事物。综上，该患者感到自己的鼻子、眼睛比以前大了一倍，为视物变形症（C对）。